可致子宫强直收缩临产胎盘娩出前禁用的药
A. 氢氯噻嗪
B. 麦角新碱
C. 阿司匹林
D. 卡托普利
E. 氯苯那敏

正确答案：B。麦角新碱

解析：本题考查药物不良反应。麦角新碱（B对）可引起子宫强直性收缩，临产胎盘娩出前禁用。